治疗经行头痛血瘀证，应选用
A. 羚角钩藤汤
B. 八珍汤
C. 补血益气汤
D. 生化汤
E. 通窍活血汤

正确答案：E。通窍活血汤

解析：经行头痛血瘀证,治法化瘀通络，用通窍活血汤（E对）。经行头痛肝火证，治法清热平肝熄风，用羚角钩藤汤（A错）。经行头痛血虚证，治法养血益气，用八珍汤（B错）。补血益气汤补中益气，补脾和胃，益气生津，滋阴养血（C错）。生化汤主治产后瘀血腹痛。恶露不行，小腹冷痛（D错）。